合并双侧肾动脉狭窄的高血压患者降压不宜首选
A. 钙通道阻滞剂
B. 血管紧张素转换酶抑制剂
C. 利尿剂
D. β受体阻滞剂
E. α受体阻滞剂

正确答案：B。血管紧张素转换酶抑制剂

解析：在肾动脉阻塞或肾动脉硬化造成的双侧肾血管病患者，血管紧张素转换酶抑制剂能加重肾功能损伤，升高血浆肌酐浓度，甚至产生氮质血症。这是因为血管紧张素Ⅱ能可通过收缩出球小动脉维持肾灌注压，血管紧张素转换酶抑制剂舒张出球小动脉，降低肾灌注压，导致肾滤过率与肾功能降低（九版药理学P204）。因此合并双侧肾动脉狭窄的高血压患者降压不宜首选血管紧张素转换酶抑制剂（B错，为本题正确答案）。钙通道阻滞剂（P255）（A对）分为二氢吡啶类和非二氢吡啶类，心力衰竭、窦房结功能低下或心脏传导阻滞患者不宜应用非二氢吡啶类。电解质紊乱或高尿酸血症的患者不宜使用利尿剂（C对）。急性心力衰竭、病态窦房结综合征、房室传导阻滞患者不宜使用β受体阻滞剂（D对）。用于抗高血压治疗的α受体阻滞剂（E对）主要为α₁受体阻滞剂，如哌唑嗪、特拉唑嗪等，因其副作用较多，目前不主张单独使用。